中央型肺癌最早出现的征象是
A. 黏液嵌塞征
B. 局限性肺气肿
C. 段或叶的肺不张
D. 阻塞性肺炎
E. 肺门阴影增浓

正确答案：E。肺门阴影增浓

解析：肺门肿块表现为分叶状或边缘不规则的肿块，故出现肺门阴影增浓（E对）。黏液嵌塞征多伴有支气管扩张（A错）中心型肺癌X线表现：①中心型肺癌早期局限于黏膜内，可异常改变。病变发展，使管腔狭窄，引起肺叶或一侧肺阻塞性肺气肿（B错），但很难发现。多数病例由于支气管狭窄、引流不畅而发生阻塞性肺炎（D错），表现为在相应部位反复发作、吸收缓慢的炎性实变继而癌瘤可将支气管完全阻塞而引起肺不张（C错）。